铸造全冠牙体预备提供的牙合面间隙一般为
A. 1～2mm
B. 0.8～1.5mm
C. 2.5mm
D. 1.5mm
E. 2.5～3mm

正确答案：B。0.8～1.5mm

解析：本题考查铸造金属全冠的（牙合）面预备。铸造全冠牙体预备提供的（牙合）面间隙一般为0.8～1.5mm（B对）。一定的厚度保证修复体的强度，过厚则没有必要，反而对牙体组织磨除多，违背了牙体修复的生物学原则。但不同时期的不同教材对（牙合）面预备的具体要求可能不同，此处以（《口腔修复学（第八版）》为准。